熟悉传染病学的潜伏期，是为了
A. 确定诊断
B. 确定检疫期
C. 预测流行趋势
D. 追踪传染来源
E. 有助于指导治疗

正确答案：B。确定检疫期

解析：传染病的病程发展分潜伏期、前驱期、症状明显期、恢复期、复发和再燃，了解潜伏期有助于传染病的诊断、确定检疫期限和协助流行病学检查（B对）。